硝酸甘油口服，经门静脉入肝，在进入体循环的药量约10%左右，这说明该药
A. 活性低
B. 效能低
C. 首过消除显著
D. 排泄快
E. 首过消除不显著，排泄慢

正确答案：C。首过消除显著